下颌义齿基托需要缓冲的地方有
A. 上唇系带
B. 上颌隆突
C. 磨牙后垫
D. 下颌隆突
E. 舌侧翼缘区

正确答案：D。下颌隆突

解析：本题考查无牙颌的解剖标志及功能分区。下颌义齿基托需要缓冲的地方有下颌隆突（D对）。缓冲区：无牙颌的骨性隆突部位，如上颌隆突、颧突、上颌结节的颊侧、下颌隆突、下颌舌骨嵴以及牙槽嵴上的骨尖、骨棱等部位，表面被覆黏膜较薄，切牙乳突内有神经和血管。这些部位均不能承受咀嚼压力，全口义齿基托组织面在上述的相应部位应做缓冲处理，以免因压迫导致疼痛，或形成支点而影响义齿的稳定。